由直径不同的金属丝材弯制而成，丝材的弹性好，固位力较强的卡环是
A. 锻丝卡环
B. 圈形卡环
C. 三臂卡环
D. 下返卡环
E. 单臂卡环

正确答案：A。锻丝卡环

解析：锻丝卡环是由直径不同的金属丝材弯制而成，丝材的弹性好，固位力较强，对基牙作用力小，结合使用铸造（牙合）支托，该卡环的固位、稳定、支持作用均较好，除整铸支架可摘局部义齿以外，锻丝卡环是我国目前可摘局部义齿设计的基本形式。掌握“局部义齿固位体”知识点。